小脑病变可见到的症状是
A. 静止性震颤
B. 动作性震颤
C. 老年性震颤
D. 扑翼样震颤
E. 手足搐搦

正确答案：B。动作性震颤

解析：小脑病变可见到的症状是动作性震颤，震颤在休息时消失，动作时发生，愈接近目的物震颤愈明显（B对）。静止性震颤见于帕金森病（A错）。老年性震颤多属于运动障碍疾病，病因未明（C错）。扑翼样震颤常见于肝性脑病等（D错）。手足搐搦见于血钙过低、血镁过低或血钠过高（E错）。